石决明表面螺旋部边缘有2行整齐的突起者，其原动物是
A. 杂色鲍
B. 羊鲍
C. 澳洲鲍
D. 耳鲍
E. 皱纹盘鲍

正确答案：B。羊鲍

解析：本题考查的是石决明药材的性状鉴别。石决明表面螺旋部边缘有2行整齐的突起者，其原动物是羊鲍（B对）。石决明：【性状鉴别】药材杂色鲍（A错）：呈长卵圆形，内面观略呈耳形。表面暗红色，有多数不规则的螺肋和细密生长线，螺旋部小，体螺部大，从螺旋部顶处开始向右排列有20余个疣状突起，末端6～9个开孔，孔口与壳面平。内面光滑，具珍珠样彩色光泽。壳较厚，质坚硬，不易破碎。气微，味微咸。皱纹盘鲍（E错）：呈长椭圆形。表面灰棕色，有多数粗糙而不规则的皱纹，生长线明显，常有苔藓类或石灰虫等附着物，末端4～5个开孔，孔口突出壳面。壳较薄。羊鲍：近圆形。壳顶位于近中部而高于壳面，螺旋部与体螺部各占1/2，从螺旋部边缘有2行整齐的突起，尤以上部较为明显，末端4～5个开孔，呈管状。澳洲鲍（C错）：呈扁平卵圆形。表面砖红色，螺旋部约为壳面的1/2，螺肋和生长线呈波状隆起，疣状突起30余个，末端7～9个开孔，孔口突出壳面。耳鲍（D错）：狭长，略扭曲，呈耳状。表面光滑，具翠绿色、紫色及褐色等多种颜色形成的斑纹，螺旋部小，体螺部大，疣状突起的末端5～7个开孔，孔口与壳平，多为椭圆形。壳薄，质较脆。白鲍：呈卵圆形。表面砖红色，光滑，壳顶高于壳面，生长线颇为明显，螺旋部约为壳面的1/3，疣状突起30余个，末端9个开孔，孔口与壳面平。